根尖周组织血管扩张充血，组织水肿，少量中性粒细胞游出血管，这一阶段称为
A. 慢性根尖周肉芽肿
B. 急性浆液性根尖周炎
C. 慢性根尖周脓肿
D. 致密性骨炎
E. 急性牙槽脓肿

正确答案：B。急性浆液性根尖周炎

解析：本题考查急慢性根尖周炎。根尖周组织血管扩张充血，浆液渗出，组织水肿，少量中性粒细胞游出血管，这一阶段称为急性浆液性根尖周炎（B对）。